属于鸟苷酸环化酶C激动剂，用于成人便秘型肠易激综合征的药物是
A. 番泻叶
B. 利那洛肽
C. 莫沙必利
D. 乳果糖
E. 聚乙二醇4000

正确答案：B。利那洛肽

解析：本题考查肠易激综合征的药物治疗。利那洛肽（B对）是鸟苷酸环化酶C激动剂，通过细胞内释放环鸟苷酸而刺激胃肠分泌，加快胃肠道运行，调节内脏敏感性，其可显著增加便秘型IBS患者自主排便频率、缓解腹痛症状，美国FDA批准其用于便秘IBS。